咽喉溃烂处上覆白腐，形如白膜者。称为
A. 乳蛾
B. 喉痈
C. 发颐
D. 咽喉成脓
E. 伪膜

正确答案：E。伪膜

解析：咽喉溃烂处上覆白腐，形如白膜者，称为伪膜（E对），是肺胃热浊之邪上壅于咽所致。乳蛾是以咽喉两侧喉核(即腭扁桃体)红肿疼痛，形似乳头，状如蚕蛾为主要症状的喉病（A错）。喉痈是指咽喉各部发生的痈疡（B错）。发颐是热病后余毒结于颐颌间引起的急性化脓性疾病，多一侧发病，颐颌部肿胀疼痛，张口受限，全身症状明显（C错）。